有关表面活性生物学性质的错误表述是
A. 表面活性剂对药物吸收有影响
B. 表面活性剂与蛋白质可发生相互作用
C. 表面活性剂中，非离子表面活性剂毒性最大
D. 表面活性剂长期应用或高浓度使用可能出现皮肤或粘膜损伤
E. 表面活性剂静脉注射的毒性大于口服

正确答案：C。表面活性剂中，非离子表面活性剂毒性最大